肺韧带是由胸膜的哪一部分构成的
A. 脏胸膜
B. 肋胸膜
C. 膈胸膜
D. 纵隔胸膜
E. 纵隔胸膜与脏胸膜移行部

正确答案：E。纵隔胸膜与脏胸膜移行部

解析：壁胸膜（纵隔胸膜）与脏胸膜的移行部构成肺韧带（E对）。